男孩5岁，营养发育中等，平时少病，根据儿童身高体重计算公式，该儿童的体重身高约为
A. 15kg、100cm
B. 16kg、110cm
C. 16kg、100cm
D. 18kg、115cm
E. 18kg、110cm

正确答案：E。18kg、110cm

解析：本题考查儿童身高和体重增长规律的综合应用。依据儿童年龄应用公式估算儿童身高和体重，体重估算公式为：体重（kg）=年龄（岁）×2+8；身高估算公式为：身高（cm）=年龄×7+75（cm），故该5岁男孩体重应为18kg，身高为110cm（E对ABCD错）。